根据《执业药师资格制度暂行规定》，通过非法手段获取《执业药师资格证书》进行执业注册的人员，发证机构应
A. 收回《执业药师资格证书》
B. 取消执业药师资格
C. 注销执业药师注册证
D. 通报批评
E. 给予1000元以下罚款

正确答案：A、B、C。收回《执业药师资格证书》；取消执业药师资格；注销执业药师注册证

解析：本题考查的是执业药师执业活动的监督管理。根据《执业药师资格制度暂行规定》，通过非法手段获取《执业药师资格证书》进行执业注册的人员，发证机构应收回《执业药师资格证书》（A对）、取消执业药师资格（B对）、注销执业药师注册证（C对）。按照12号文及药品经营质量管理相关规定，对以不正当手段取得《执业药师职业资格证书》的，按照《专业技术人员资格考试违纪违规行为处理规定》（人力资源社会保障部令第31号）相关规定处理。以欺骗、贿赂等不正当手段取得《执业药师注册证》的，由发证部门撤销《执业药师注册证》，三年内不予执业药师注册，构成犯罪的，依法追究刑事责任。对存在“挂证”行为的执业药师，撤销其《执业药师注册证》，在全国执业药师注册管理信息系统进行记录，并予以公示，在不良信息记录撤销前，不能再次注册执业。药品零售企业存在“挂证”执业药师的，按严重违反《药品经营质量管理规范》情形进行处罚。